材料一：甲因其子（8周岁）连续咳嗽一周，到某药品零售连锁企业门店购药。当时该零售企业执业药师不在岗，由工作人员乙详细询问甲，了解患者是否发烧、是否咳痰，在得知未发烧、咳黄痰后，向甲推荐盐酸氨溴索口服液（按甲类非处方药管理）和维生C素泡腾片（按乙类非处方药管理），甲凭以往用药经验，向乙提出新的购药需求购买中成药抗病毒口服液（外包装上有绿色OTC标识）和小儿退烧药。甲购买药品给其子使用一周后，症状未改善。甲再次前往该门店，向门店执业药师表示想购买磷酸可待因糖浆给其子使用。根据背景材料，关于该零售企业能否销售中成药抗病毒口服液的说法，正确的是
A. 抗病毒口服液应按处方药管理，不应销售
B. 不能根据患者的要求直接销售抗病毒口服液
C. 在不能确定儿童能否使用抗病毒口服液的情况下，不能销售
D. 可查询药品说明书中【用法用量】【注意事项】等项目，在做好用药交代的基础上销售

正确答案：C。在不能确定儿童能否使用抗病毒口服液的情况下，不能销售

解析：本题考查的是非处方药的销售。甲因其子（8周岁）连续咳嗽一周，到某药品零售连锁企业门店购药。当时该零售企业执业药师不在岗，由工作人员乙详细询问甲，了解患者是否发烧、是否咳痰，在得知未发烧、咳黄痰后，向甲推荐盐酸氨溴索口服液（按甲类非处方药管理）和维生C素泡腾片（按乙类非处方药管理），甲凭以往用药经验，向乙提出新的购药需求购买中成药抗病毒口服液（外包装上有绿色OTC标识）和小儿退烧药。甲购买药品给其子使用一周后，症状未改善。甲再次前往该门店，向门店执业药师表示想购买磷酸可待因糖浆给其子使用。根据背景材料，关于该零售企业能否销售中成药抗病毒口服液的说法，正确的是在不能确定儿童能否使用抗病毒口服液的情况下，不能销售（C对）。非处方药专有标识图案分为红色和绿色，红色专有标识用于甲类非处方药品，绿色专有标识用于乙类非处方药品（A错）和用作指南性标志。乙类非处方药的确定：根据《乙类非处方药确定原则》［《国家食品药品监督管理局办公室关于印发处方药转换为非处方药评价指导原则（试行）等6个技术文件的通知》（食药监办注（2012）137号）］，乙类非处方药是指在一般情况下，消费者不需要医生及药师的指导，可以自我购买和使用的药品（B错），与甲类非处方药相比，其安全性更好，消费者自行使用的风险更低。乙类非处方药应是用于常见轻微疾病和症状，以及日常营养补充等的非处方药药品。以下情况下不应作为乙类非处方药：儿童用药（有儿童用法用量的均包括在内，维生素、矿物质类除外）；化学药品含抗菌药物、激素等成分的；中成药含毒性药材（包括大毒和有毒）和重金属的口服制剂、含大毒药材的外用制剂；严重不良反应发生率达万分之一以上；中成药组方中包括无国家或省级药品标准药材的（药食同源的除外）；中西药复方制剂；辅助用药。